某女，18岁，今年如愿考上了大学，参加新生体检时，身高160cm，体重75kg。针对她的营养状况，可采取的措施包括
A. 控制饮食与适量运动相结合
B. 取消早餐
C. 每天减少40%摄入量
D. 每天运动3小时
E. 不吃晚饭

正确答案：A。控制饮食与适量运动相结合